白交通支为
A. 交感节前纤维
B. 交感节后纤维
C. 副交感节前纤维
D. 副交感节后纤维
E. 以上都不对

正确答案：A。交感节前纤维

解析：白交通支主要由有髓鞘的节前纤维组成，所以白交通支为交感节前纤维（A对）。